女，53岁。腹痛、腹胀、低热4周，表情淡漠、嗜睡1天。腹部B超示：肝实质弥漫性病变、脾大及腹水。对该患者诊断最有意义的阳性体征是
A. 肌张力增高
B. Babinski征阳性
C. 扑翼样震颤阳性
D. 腹壁反射消失
E. 腱反射亢进

正确答案：C。扑翼样震颤阳性

解析：中年女性患者，腹部B超示：肝实质弥漫性病变（提示原发病灶在肝脏）、脾大及腹水（提示有肝硬化的可能，肝硬化为肝性脑病最常见的病因），表情淡漠、嗜睡1天（肝性脑病的表现）。综合患者的病史、临床表现、影像学检查，可初步诊断为肝性脑病。扑翼样震颤（C对）为肝性脑病的特征性体征，是指病人平伸手指及腕关节时，腕关节突然屈曲，然后又迅速伸直，如此震颤多动，类似鸟的翅膀在扇动，是由于基底节病变及小脑共济失调所致。2期和3期肝性脑病患者可有肌张力增高（A错）、Babinski征阳性（B错）、腱反射亢进（E错），但这些体征常见于锥体束损伤，无特异性。腹壁反射消失（D错）常见于胸部脊髓损伤。